《公共场所卫生管理条例》所指的“有碍公共卫生的疾病”，不包括
A. 伤寒
B. 甲型病毒性肝炎
C. 活动性肺结核
D. 突发性失聪
E. 化脓性皮肤病

正确答案：D。突发性失聪